患者女性，24岁，妊娠38周。头晕眼花1天。体格检查：血压：160/96mmHg，产科检查：宫底位于脐与剑突之间，胎头固定，枕右前位，胎心142次/分，尿蛋白（＋＋）。本例正确的诊断应是
A. 急性肾炎（肾病型）
B. 轻度妊娠高血压综合征
C. 子痫前期
D. 高血压病
E. 中度妊娠高血压综合征

正确答案：C。子痫前期

解析：本题考查娠期高血压疾病。子痫前期（C对）的症状包括明显的水肿、高血压和蛋白尿。子痫前期加重的表现有头晕、视力模糊、剧烈的头痛、上腹部和肋下痛，可能还会伴有恶心。